用于治疗干眼症的药物是
A. 聚乙二醇滴眼液
B. 硫酸阿托品眼用凝胶
C. 雷珠单抗注射液
D. 毛果芸香碱滴眼液
E. 丙美卡因滴眼液

正确答案：A。聚乙二醇滴眼液

解析：本题考查聚乙二醇滴眼液。用于治疗干眼症的药物是聚乙二醇滴眼液（A对）。硫酸阿托品眼用凝胶（B错）为散瞳药。雷珠单抗注射液（C错）为血管内皮生长因子（VEGF）抑制剂。毛果芸香碱滴眼液（D错）选择性直接作用于M胆碱受体。主要用于治疗原发性青光眼，包括开角型与闭角型青光眼。丙美卡因滴眼液（E错）用于眼科局部麻醉。